某无牙颌患者，义齿戴用7年。自觉咀嚼无力，面显苍老。其原因是
A. 垂直距离过高
B. 垂直距离过低
C. 咬合不平衡
D. 下颌前伸
E. 义齿固位差

正确答案：B。垂直距离过低

解析：本题考查垂直距离恢复不正确的临床表现。垂直距离就是指自然牙列呈正中（牙合）时，鼻底至髁底的距离，也就是面部下1/3的距离。无牙颌患者全口义齿戴用7年，就会存在很大程度的磨耗，进而导致患者的面下1/3距离减少，患者面部表现为口角下垂，鼻唇沟变浅，面显苍老，其原因就是因义齿磨耗造成的垂直距离过低（B对）。 垂直距离过高（A错）表现为患者面下1/3距离增高，上下唇张开，勉强闭合上下唇时，颏唇沟变浅，肌肉张力增加，容易出现肌肉疲劳感，与面容苍老无关。咬合不平衡（C错）表现为义齿在正中咬合和侧方牙合时早接触或牙合干扰，在牙槽顶或嵴的斜面上，产生弥散性发红的刺激区域，与面容苍老无关。下颌前伸（D错）表现为义齿咬合紊乱，上颌后牙不能咬在对应下牙的窝沟内，而咬在其远中位置，患者面部下颌向前伸出，患者颞下颌关节区疼痛，与面容苍老无关。义齿固位差（E错）表现为义齿容易松动脱位，与面容苍老无关。